芦丁的结构中含有
A. 黄酮母核结构单元
B. 酚羟基结构单元
C. 糖结构单元
D. 香豆素母核结构单元
E. 环烯醚萜结构单元

正确答案：A、B、C。黄酮母核结构单元；酚羟基结构单元；糖结构单元

解析：本题考查的是芦丁的结构。芦丁的结构中含有黄酮母核结构单元（A对）、酚羟基结构单元（B对）、糖结构单元（C对）。多数的黄酮苷类化合物是由黄酮苷元和各种糖形成的苷，芦丁是其典型的代表，这些黄酮苷体内代谢途径具有相似性。具有双糖结构的芦丁，在肠道菌群的作用下，水解生成槲皮素，槲皮素在人体的生物半衰期很短，约8.8分钟。芦丁到达结肠部位，可被一些混合菌完全水解，形成开环产物3，4-二羟基苯甲酸，进一步生成3-羟基苯甲酸或4-羟基-3-甲氧基苯乙酸等。